具有抑制补体活化作用的是
A. CD
B. CAM
C. CR1
D. CKR
E. FcR

正确答案：C。CR1